三叉神经疼痛性质如
A. 电击样
B. 针刺样
C. 刀割样
D. 撕裂样
E. 以上均是

正确答案：E。以上均是

解析：本病的主要表现是在三叉神经某分支区域内，骤然发生闪电式的极为剧烈的疼痛，疼痛如电击、针刺、刀割或撕裂样。掌握“三叉神经痛”知识点。